根据团队存在的目的和拥有的自主权大小，可将社区卫生服务团队分为（）类型
A. 两种
B. 三种
C. 四种
D. 五种
E. 六种

正确答案：B。三种